脊髓
A. 中央管上通第三脑室
B. 主要由灰质构成
C. 灰质围绕在白质周围
D. 白质可分为前索、外侧索和后索
E. 网状结构位于两前脚之间

正确答案：D。白质可分为前索、外侧索和后索

解析：脊髓的中央管上通第四脑室（A错），分为灰质和白质两部分（B错）,白质围绕在灰质的周围（C错），白质借脊髓的纵沟分为3个索，前正中裂与前外侧沟之间为前索,前、后外侧沟之间为外侧索,后外侧沟与后正中沟之间为后索（D对），网状结构位于灰质和白质之间（E错）。